压应力结合占金-瓷结合强度
A. 0.6
B. 0.49
C. 0.26
D. 0.22
E. 0.03

正确答案：C。0.26

解析：压应力结合：由于陶瓷的热膨胀系数略小于烤瓷合金，瓷粉烧结后冷却时金属的收缩量大于陶瓷，使陶瓷承受一定的压力。在合金与陶瓷的结合界面处，陶瓷内部的压应力构成了合金与陶瓷的结合力，占金-瓷结合强度的26%。掌握“修复材料、金瓷结合及树脂粘结机制”知识点。